血管紧张素I经过血管紧张素转换酶（ACE）作用可以转变为
A. 前列腺素
B. 肾素
C. 血管紧张素
D. 内皮素
E. 前列环素

正确答案：C。血管紧张素